主治瘀热互结之肠痈的代表方是
A. 大黄牡丹汤
B. 千金苇茎汤
C. 普济消毒饮
D. 阳和汤
E. 仙方活命饮

正确答案：A。大黄牡丹汤

解析：大黄牡丹汤方含大黄、芒硝、冬瓜仁、丹皮、桃仁，可泻湿热，破瘀血，散结肿，主治肠痈初起，湿热瘀滞证（A对）--大黄苦寒攻下，泻肠中湿热郁结，并祛肠中稽留之瘀血；桃仁性善破血消痈，共为君药。芒硝咸寒，软坚散结，泻下清热，助大黄通腑泻热；牡丹皮凉血散瘀消肿，助君药活血祛瘀，共为臣药；冬瓜子甘寒，清肠利湿，排脓散结，为佐药。